患者，女性，43岁。因开口严重受限3个月就诊。临床检查开口度10mm，无明显疼痛，无弹响和杂音，右侧升颌肌群发硬有压痛，听诊器可听到肌杂音。最可能的诊断是
A. 右侧翼外肌亢进
B. 右侧翼外肌痉挛
C. 右侧咀嚼肌群痉挛
D. 右侧肌筋膜痛
E. 右颞下颌关节炎性疾病类

正确答案：C。右侧咀嚼肌群痉挛

解析：本题考查颞下颌关节紊乱。咀嚼肌痉挛的典型表现是疼痛和开口受限。题干中提示“右侧升颌肌群发硬有压痛”，而非翼外肌的位置有疼痛，故位右侧咀嚼肌群痉挛（C对）。